急性龈乳头炎的病因不包括
A. 机械刺激
B. 化学刺激
C. 菌斑刺激
D. 不良修复体刺激
E. 食物嵌塞刺激

正确答案：C。菌斑刺激

解析：本题考查急性龈乳头炎的病因。菌斑（C错，为本题的正确答案）属于慢性长期刺激，一般引起慢性龈炎，而急性龈乳头炎是急性过程。牙龈乳头受到机械（A对）或化学的刺激（B对），是引起急性龈乳头炎的直接原因。食物嵌塞造成牙龈乳头的压迫及食物发酵产物的刺激可引起龈乳头的急性炎症（E对）。充填体的悬突、不良修复体的边缘、义齿的卡环尖以及不良的松牙固定等均可刺激龈乳头，造成牙龈乳头的急性炎症（D对）。